口腔颌面部脓肿形成以后，主要的治疗措施是
A. 外敷中药
B. 大剂量抗生素
C. 局部热敷
D. 脓肿切开引流
E. 大剂量激素

正确答案：D。脓肿切开引流

解析：脓肿形成以后，应切开引流，使脓液或腐败坏死物迅速排出体外，以达消炎解毒的目的。掌握“口腔颌面部感染概论”知识点。